分子中含有氨基酮结构，戒断症状较轻，常用作戒毒的药物
A. 吗啡
B. 曲马多
C. 盐酸美沙酮
D. 盐酸哌替啶
E. 盐酸纳洛酮

正确答案：C。盐酸美沙酮

解析：本题考查氨基酮类镇痛药。盐酸美沙酮（C对）为氨基酮类镇痛药，戒断症状较吗啡轻，临床上主要被用于治疗海洛因依赖脱毒和替代维持治疗的药效作用。吗啡（A错）是具有菲环结构的生物碱，是由5个环稠合而成的复杂立体结构。曲马多（B错）是其他合成镇痛药，是微弱的µ阿片受体激动药，分子中有两个手性中心，临床用其外消旋体。盐酸哌替啶（D错）属于4-苯基哌啶类结构的镇痛药。纳洛酮（E错）是将吗啡酯化后，以烯丙基、环丙基甲基或环丁基甲基取代N-甲基得到的产物。